真菌的繁殖器官是
A. 芽胞
B. 菌丝体
C. 芽管
D. 菌丝
E. 孢子

正确答案：E。孢子

解析：真菌是通过有性孢子或者无性孢子进行繁殖，孢子是真菌的生殖结构，是由生殖菌丝产生的。掌握“真菌概述及主要病原性真菌”知识点。